扩张小动脉，小静脉，作用强快短的扩血管药物是
A. 地高辛
B. 氨茶碱
C. 卡托普利
D. 肼屈嗪
E. 硝普钠

正确答案：E。硝普钠